红霉素的药理作用和临床应用有
A. 抑制细菌蛋白质合成
B. 治疗大肠杆菌引起的肠炎
C. 治疗支原体引起的肺炎
D. 治疗衣原体引起的尿道炎
E. 干扰细菌核酸代谢

正确答案：A、C、D。抑制细菌蛋白质合成；治疗支原体引起的肺炎；治疗衣原体引起的尿道炎

解析：本题考查红霉素。红霉素属于大环内酯类抗生素，通过抑制细菌蛋白质合成（A对）发挥抗菌作用。红霉素能够治疗军团菌病、百日咳、支原体肺炎（C对）及泌尿生殖系统衣原体感染（D对）。